氨基酸的主要分解代谢方式为
A. 肠道吸收
B. 肾脏产氨
C. 氨基酸脱氨基
D. 氨分解
E. 碱基分解

正确答案：C。氨基酸脱氨基

解析：氨基酸的主要分解方式为脱去氨基生成氨，这是体内代谢作用产生氨的主要途径。掌握“氨基酸及氨的代谢”知识点。